羟甲戊二酰辅酶A还原酶抑制剂（他汀类药）主要经细胞色素酶CYP3A4代谢，不宜与其联合应用的药品有
A. 环孢素
B. 酮康唑
C. 克拉霉素
D. 氟西汀
E. 青霉素

正确答案：A、B、C。环孢素；酮康唑；克拉霉素

解析：本题考查药物的相互作用。环孢素（A对）、伊曲康唑、酮康唑（B对）、克拉霉素（C对）、罗红霉素为CYP3A4肝药酶抑制剂，而羟甲戊二酰辅酶A还原酶抑制剂（他汀类药）主要经细胞色素酶CYP3A4代谢，可抑制胆固醇的合成，降低血浆低密度脂蛋白胆固醇、总胆固醇和三酰甘油的水平，合用会显著增高后者的血浆水平，故不宜与其联合应用。